分子中含有嘧啶结构的抗肿瘤药物有
A. 吉西他滨
B. 卡莫氟
C. 卡培他滨
D. 巯嘌呤
E. 氟达拉滨

正确答案：A、B、C。吉西他滨；卡莫氟；卡培他滨

解析：本题考查抗肿瘤药物的结构。分子中含有嘧啶结构的抗肿瘤药物有吉西他滨（A对）、卡莫氟（B对）、卡培他滨（C对）。